糖尿病肾病的表现是
A. 蛋白尿、浮肿
B. 糖尿病酮症酸中毒
C. 疼痛及脓肿
D. 糖尿病足病
E. 糖尿病性胃轻瘫

正确答案：A。蛋白尿、浮肿

解析：本题考查糖尿病并发症。糖尿病肾病最终表现有蛋白尿、浮肿（A对）、高血压、肾功能减退等。糖尿病酮症酸中毒（B错）属于糖尿病急性并发症。糖尿病足病（D错）是慢性并发症。疼痛及脓肿（C错）、糖尿病性胃轻瘫（E错）均不属于糖尿病肾病。